药物性牙龈肥大牙龈表现为
A. 龈增生呈细小分叶状、球状
B. 牙龈肿大颜色暗红发绀或苍白，龈缘处组织坏死、溃疡
C. 龈乳头呈球样增生、质软多见于前牙唇侧
D. 增生牙龈覆盖牙冠，质地坚韧，颜色正常或发白
E. 龈肥大、淡粉色，质硬

正确答案：E。龈肥大、淡粉色，质硬

解析：本题考查药物性牙龈肥大的临床表现。药物性牙龈增生（肥大）是指长期服用某些药物而引起牙龈的纤维性增生和体积增大。龈肥大、淡粉色，质硬（E对）。增生的牙龈波及全口牙，以上下前牙区较重，增生起始于唇颊侧或舌腭侧龈乳头，牙龈呈球形，结状性增生。增生范围可由边缘龈到附着龈，累及范围较大。牙龈呈纤维性增生，质地坚韧有弹性，一般不易出血。龈增生呈细小分叶状、球状（A错）为牙龈瘤。牙龈肿大颜色暗红发绀或苍白，龈缘处组织坏死、溃疡（B错）为白血病的牙龈病损。龈乳头呈球样增生、质软多见于前牙唇侧（C错）多为妊娠期龈炎。增生牙龈覆盖牙冠，质地坚韧，颜色正常或发白（D错）为遗传性牙龈纤维瘤病。